前列腺的位置与毗邻
A. 位于膀胱和尿生殖膈之间
B. 前面与耻骨相邻
C. 后面与直肠毗邻，故活体通过直肠指诊可触及
D. 底与精囊腺、输精管壶腹相接触
E. 上述全部正确

正确答案：E。上述全部正确

解析：前列腺位于膀胱与尿生殖膈之间。前方为耻骨联合。后方为直肠壶腹。底与膀胱颈、精囊腺和输精管壶腹相邻。（ABCD对,故E为本题正确答案）。